心胸憋闷刺痛，痛处不移的心脉痹阻证，其病因是
A. 寒凝
B. 瘀阻
C. 气滞
D. 痰阻
E. 气虚

正确答案：B。瘀阻

解析：心脉痹阻证指瘀血、痰浊、阴寒、气滞等因素阻痹心脉，以心悸怔忡、心胸憋闷疼痛为主要表现的证。瘀阻心脉证以刺痛为特点，伴见舌质晦暗，或有青紫色斑点，脉细涩或结或代等瘀血内阻的症状（B对）。寒凝心脉以痛势剧烈，突然发作，遇寒加剧，得温痛减为特点，伴见形寒肢冷，舌淡或青紫，苔白，脉沉迟或沉紧等寒邪内盛的症状（A错）。气滞心脉，以胀痛为特点，其发作多与精神因素有关，常伴见胁胀，善太息，脉弦等气机郁滞的症状（C错）。痰阻心脉，以憋闷为特点，多伴体胖痰多，身重困倦，苔白腻，脉沉滑或沉涩等痰浊内盛的症状（D错）。心气虚证，指心气不足，鼓动无力，以心悸怔忡及气虚症状为主要表现的证（E错）。